止嗽散的功用是
A. 宣肺解表、止咳平喘
B. 宣肺利气、疏风止咳
C. 宣肺化痰、止咳定喘
D. 疏风清热、止咳化痰
E. 宣降肺气、化痰止咳

正确答案：B。宣肺利气、疏风止咳

解析：止嗽散由百部、紫菀、白前、桔梗、甘草、荆芥、陈皮组成，方中紫菀、百部为君，止咳化痰；桔梗、白前一宣一降，以复肺气之宣降；荆芥疏风解表，陈皮行气化痰；甘草合桔梗利咽止咳，兼调和诸药；诸药相合，共奏宣肺利气，疏风止咳之功（B对）。